男，55岁。因低位直肠癌行Dixon术，术后吻合口位于齿状线上1cm。患者术后最可能出现的情况是
A. 排便前无明显便意，排便控制不理想
B. 性功能障碍
C. 排便功能完全正常
D. 排尿功能障碍
E. 排便前有便意，但不能控制排便

正确答案：C。排便功能完全正常

解析：患者的Dixon手术吻合口位于齿状线上1cm，保留了肛管和部分下端直肠。直肠下段是排便反射的主要发生部位，齿状线至齿状线上1cm对粪便刺激最敏感，术后排便功能完全正常（C对AE错）。性功能障碍（B错）、排尿功能障碍（D错）为阴部神经损伤的表现，Dixon手术发生率较低。